男，71岁，反复活动时心前区疼痛3个月，5小时前情绪激动时再次发作，持续不缓解，高血压病史10年，查体：110/65mmHg，双肺呼吸音清，心率96次/分，律齐，未闻及杂音，血肌钙蛋白升高，心电图V₁～V₄导联ST段压低0.1mv，T波低平，不适宜的治疗是
A. 抗血小板及抗凝治疗
B. 硝酸酯类药物
C. 溶栓治疗
D. β受体拮抗剂
E. 他汀类药物

正确答案：C。溶栓治疗

解析：患者老年男性，反复活动时心前区疼痛3个月（提示心绞痛病史），5小时前情绪激动时再次发作，持续不缓解，高血压病史10年，查体：110/65mmHg（正常值90～120/60～90mmHg），双肺呼吸音清，心率96次/分（正常值60～100次/分），律齐，未闻及杂音，血肌钙蛋白升高（提示心力衰竭），心电图V₁～V₄导联ST段压低0.1mv（心内膜下心肌缺血常ST段压低），T波低平。根据患者病史、症状及心电图，考虑患者诊断为非ST段抬高型心肌梗死。急性期使用硝酸甘油治疗，缓解期的治疗可选择β体拮抗剂（D对）、硝酸酯类药物（B对）和钙通道阻滞剂来改善缺血、减轻症状；用抗血小板药物（A对）抗凝和他汀类药物（E对）降低LDL-C，预防心肌梗死、改善预后，不需要溶栓治疗（C错，为本题正确答案）。ST段抬高型心肌梗死如果预计PCI时间大于120分钟，则首选溶栓治疗。